屈膝关节并外旋小腿
A. 腘肌
B. 半腱肌
C. 半膜肌
D. 股二头肌
E. 比目鱼肌

正确答案：D。股二头肌

解析：腘肌（A错）屈膝关节和使小腿旋内。半腱肌（B错）和半膜肌（C错）屈膝、伸髋，使已屈的膝关节旋内。股二头肌（D对）屈膝、伸髋，使已屈的膝关节旋外。比目鱼肌（E错）屈踝关节和膝关节。